地表水水源卫生防护规定，严禁捕捞、网箱养殖、停靠船只、游泳和从事其他可能污染水源的取水点周围半径为
A. 10m
B. 50m
C. 100m
D. 500m
E. 1000m

正确答案：C。100m

解析：本题考查地表水水源卫生防护规定。地表水水源卫生防护规定，取水点周围半径100m（C对ABDE错）的水域内，严禁捕捞、网箱养殖、停靠船只、游泳和从事其他可能污染水源的任何活动。